根据《中华人民共和国药品管理法》国家药品监督管理部门核发的是
A. 零售企业《药品经营许可证》
B. 《药品生产许可证》
C. 《医疗机构制剂许可证》
D. 《进口药品通关单》
E. 《进口药品注册证》

正确答案：E。《进口药品注册证》

解析：本题考察药品管理。根据《中华人民共和国药品管理法》国家药品监督管理部门核发的是《进口药品注册证》（E对）。省级药品监督管理部门核发的是《药品生产许可证》。